某执业药师在执业过程中，发现从供货单位购进的降糖药质量可疑，根据执业药师的职业道德要求，对该批药的最佳处理方式是
A. 要求供货单位尽快换货
B. 将余下药品退回供货单位
C. 因为没有确认为假药可以继续使用
D. 在退货的同时，及时报告当地药品监督管理部门
E. 不能退、换货，及时报告当地药品监督管理部门

正确答案：E。不能退、换货，及时报告当地药品监督管理部门

解析：本题考查执业药师职责。执业药师应确保药品质量，发现质量可疑的药品，应当立即停止销售，并及时报告当地药监部门，不能退、换货（E对）。